椎间盘髓核脱出的常见方位是
A. 正前方
B. 正后方
C. 左侧或右侧
D. 前外侧
E. 后外侧

正确答案：E。后外侧

解析：由于椎间盘后侧是椎间孔或椎管，所以在承受的压力比较大，纤维环破裂时，椎间盘易向后外侧（E对）突出。